牙周炎积极治疗结束后，必须进行牙周支持治疗的原因是
A. 牙菌斑是不断沉积的，必要由专业人员定期进行清洁
B. 积极治疗阶段可能遗留少量龈下菌斑
C. 牙周袋深处及根分叉病变深部仍可能存在慢性炎症
D. 有些治疗的缺陷或遗漏部分在维护期内会逐渐暴露出来
E. 以上均是

正确答案：E。以上均是

解析：本题考查牙周支持治疗的必要性。牙周炎积极治疗结束后，必须进行牙周支持治疗的原因是：①牙菌斑是不断沉积的，必需由专业人员定期进行清洁（A对），才能有效控制菌斑。②积极治疗阶段可能遗留少量龈下菌斑（B对），在复诊期间进行进一步治疗，彻底去除菌斑和牙石。③牙周袋深处及根分叉病变深部仍可能存在慢性炎症（C对），需要在复诊时采取必要的牙周手术治疗。④有些治疗的缺陷或遗漏部分在维护期内会逐渐暴露出来（D对），对暴露的治疗缺陷或遗留部分进一步治疗。（ABCD均对，故E为本题的正确答案）。